氨基糖苷类的作用机制是
A. 抑制细菌蛋白质合成
B. 抑制细菌细胞壁合成
C. 与PABA相竞争
D. 抑制二氢叶酸还原酶
E. 抑制DNA回旋酶

正确答案：A。抑制细菌蛋白质合成

解析：本题考查氨基糖苷类药物的作用机制。氨基糖苷类药的抗菌作用机制是抑制细菌蛋白质的合成（A对）。头孢菌素类药物的抗菌作用机制为抑制细菌细胞壁的合成（B错）。磺胺类药与对氨基苯甲酸（PABA）竞争（C错）二氢叶酸合成酶，组织细菌二氢叶酸的合成，最终抑制细菌生长繁殖。甲氧苄啶的作用机制为抑制细菌二氢叶酸还原酶（D错）。氟喹诺酮类药的作用机制为抑制DNA回旋酶（E错），影响DNA的合成而导致细菌死亡。